晚期复发性流产最常见于
A. 先天性卵巢发育异常
B. 妊娠合并卵巢囊肿
C. 子宫颈内口松弛
D. 孕卵发育异常
E. 黄体发育不健全

正确答案：C。子宫颈内口松弛

解析：早期流产常见原因为胚胎染色体异常，免疫功能异常、黄体功能不足、甲状腺功能减退症等；晚期流产常见原因为宫颈内口松弛等。掌握“自然流产”知识点。